男婴，1岁，近日哭闹、拒食、流涎，检查见邻近磨牙的上腭和龈缘处见大面积浅表溃疡，上覆黄色假膜，偶见个别针头大小小水疱。治疗该病的正确方法是
A. 泼尼松片60mg/d，分3次口服，控制病情后减量
B. 口服各种维生素及微量元素
C. 局部使用洗必泰含漱剂清洗患儿口腔，口服病毒唑
D. 注射链霉素每日0.5g，或异烟肼每日0.1g局部封闭，每日或隔日一次
E. 局部使用2%碳酸氢钠清洗患儿口腔，口服酮康唑

正确答案：C。局部使用洗必泰含漱剂清洗患儿口腔，口服病毒唑

解析：本题考查口腔单纯疱疹。患者为急性疱疹性口炎，局部治疗为局部使用洗必泰含漱剂清洗患儿口腔，口服病毒唑（C对）。局部治疗：口腔黏膜用药对原发性单纯疱疹病毒感染引起的疱疹性龈口炎是不可缺少的，常使用的制剂有溶液、糊剂、散剂及含片。①0.1%～0.2%葡萄糖酸氯己定溶液、复方硼酸溶液、0.1%依沙吖啶溶液漱口，皆有消毒杀菌作用。体外研究认为氯己定液对Ⅰ型单纯疱疹病毒的生长有抑制能力，浓度增高，抑制力越强，并对病毒的细胞溶解作用也有抑制作用；体内试验认为0.2%的氯己定对Ⅰ型单纯疱疹病毒有抑制作用。②3%阿昔洛韦软膏或酞丁安软膏局部涂擦，可用治疗唇疱疹。③散剂，如锡类散、养阴生肌散、西瓜霜粉剂等均可局部使用。④含片，可用葡萄糖酸氯己定片5mg、溶菌酶片20mg、西地碘含片1.5mg等含化，每天3～4次。⑤唇疱疹继发感染时，可用温的生理盐水、0.1%～0.2%氯己定液或0.01%硫酸锌液湿敷。锌可抑制Ⅰ型单纯疱疹病毒DNA聚合酶，进而直接影响病毒的复制。抗生素糊剂，如5%金霉素甘油糊剂，或5%四环素甘油糊剂局部涂搽。